下列有关拔牙前的准备叙述中，不正确的是
A. 术前应进行必要的解释工作，以取得患者的主动配合
B. 简要询问病史，特别注意有无拔牙禁忌证
C. 必要时应作各种相关的补充检查
D. 高血压患者近期血压稳定，则不必再测量血压
E. 术前应对术中可能出现的问题进行预测、制定对策

正确答案：D。高血压患者近期血压稳定，则不必再测量血压

解析：高血压患者在术前应测量血压，在注意血压值的同时，还应注意患者的自觉症状、既往血压最高值和近期血压波动情况。掌握“牙拔除术前准备、器械、心血管及拔牙愈合过程”知识点。